下列哪种疾病导致的咳嗽声音呈嘶哑样
A. 胸膜炎
B. 声带疾患
C. 纵隔肿瘤
D. 急性喉炎
E. 支气管癌

正确答案：D。急性喉炎

解析：咳嗽的音色对提示诊断有一定的意义。嘶哑样咳嗽，可见于声带炎、急性喉炎（D对）、喉癌，以及肺癌、扩张的左心房或主动脉瘤压迫喉返神经。胸膜炎（A错）较少咳嗽，主要的表现为与呼吸运动有关的胸部疼痛。声带疾患（B错），声带的主要功能是主要功能是振动以发声。声带肌肉受迷走神经的控制，可以调整声带的张力，以改变振动频率，声带疾患时咳嗽常表现为咳嗽无力。纵隔肿瘤（C错）常表现为金属调咳嗽，这是由于肿瘤压迫气管导致。支气管癌（E错）也呈金属调咳嗽，这是由于肿瘤压迫气管导致。